在化学结构的8位上有取代基产生位阻而不会与茶碱发生相互作用的氟喹诺酮抗菌药是
A. 环丙沙星
B. 洛美沙星
C. 诺氟沙星
D. 培氟沙星
E. 依诺沙星

正确答案：B。洛美沙星